患者，女，68岁，体重54kg，因慢性阻塞性肺病急性加重再次入院，入院后生化检查ALT20IU/L，血肌酐（Cr）1.8mg/dl，痰培养为铜绿假单胞菌，临床选用头孢他啶。查询头孢他啶药品说明书，成人常用剂量为1日1.5～6g，分2～3次给药；肌酐清除率为31～50ml/min时，剂量为每12小时lg；肌酐清除率为16～30ml/min时，剂量为每24小时1g；肌酐清除率为6～15ml/min时，剂量为每24小时0.5g；肌酐清除率为≤5ml/min时，剂量为每48小时0.5g；成年男性的肌酐清除率计算公式为Cer=（140-年龄）×体重/（72×Cr），成年女性的肌酐清除率为男性的0.85。该患者的肌酐清除率约是
A. 25.5ml/min
B. 30ml/min
C. 34ml/min
D. 40ml/min
E. 47.2ml/min

正确答案：A。25.5ml/min

解析：本题考查肌酐清除率的计算。成年男性的肌酐清除率计算公式：Ccr=（140-年龄）×体重/（72×Scr），成年女性=成年男性Ccr×0.85。题干信息：患者，女，68岁，体重54kg，血肌酐（Scr）为1.8mg/dl，Ccr=（140-68）×54/（72×1.8）=30，该患者为女性，Ccr=30×0.85=25.5ml/min（A对）。